1996年共发生200例某病病人，在1996年年初已知有800例病人，年内因该病死亡40例，年中人口数1000万，如果该病的发生和因该病死亡的事件均匀分布在全年中，则：1996年该病的发病率（1/10万）是
A. 0.4
B. 8
C. 10
D. 1.6
E. 2

正确答案：E。2

解析：本题考查发病率的计算。发病率计算时分子为一定时期内某人群中某病的新发病例，旧病例不算在其中，分母同期该人群的暴露人口数，因此计算得发病率为2（E对ABCD错）/10万。